盐酸吗啡需要检査的特殊杂质是
A. 麻黄碱
B. 罂粟碱
C. 莨菪碱
D. 阿扑吗啡
E. 其他金鸡纳碱

正确答案：B、D。罂粟碱；阿扑吗啡

解析：本题考查盐酸吗啡的特殊杂质。盐酸吗啡中特殊杂质检查包括阿扑吗啡（D对）、罂粟碱（B对）和提取过程中可能引入的其他生物碱。莨菪碱（C错）是硫酸阿托品的特殊杂质。其他金鸡纳碱（E错）是硫酸奎宁的特殊杂质。